公平合理分配卫生资源在微观方面的根据应除外
A. 预防与治疗的合理关系
B. 病人的年龄
C. 治疗成功的可能
D. 病人的潜在贡献
E. 科研价值

正确答案：A。预防与治疗的合理关系